大便隐血试验阳性，提示消化道出血量在
A. 5～20mL
B. 30～40mL
C. 50～70mL
D. 80～100mL
E. 120mL以上

正确答案：A。5～20mL

解析：大便隐血试验阳性提示消化道出血量为5～20mL（A对）。出现柏油样便提示消化道出血量为50～70mL。胃内储血量在250～300mL可引起呕血。出血量超过400mL可出现全身症状。